以下关于精神障碍的再次诊断和治疗，说法错误的是
A. 精神障碍患者已经发生危害他人情形，患者不同意入院治疗的，不能进行再次要求诊断和鉴定
B. 患者或监护人要求再次诊断的，应当自收到诊断结论之日起3日内提出申请
C. 承担再次诊断的医疗机构应当指派2名初次诊断医师以外的精神科执业医师进行再次诊断
D. 再次诊断不能确定就诊者为严重精神障碍患者，医疗机构不得对其进行住院治疗
E. 在相关机构出具再次诊断证明之前，精神障碍患者的收治机构应当按照诊疗规范的要求对患者实施住院治疗

正确答案：A。精神障碍患者已经发生危害他人情形，患者不同意入院治疗的，不能进行再次要求诊断和鉴定

解析：精神障碍患者已经发生危害他人安全的行为，或者有危害他人安全的危险情形的，患者或者其他监护人对需要住院治疗的诊断结论有异议，不同意对患者实施住院治疗的，可以要求再次诊断和鉴定。其他说法均正确。掌握“精神障碍概述、预防、诊断和治疗”知识点。